在DNA和RNA分子中
A. 核糖和碱基都相同
B. 核糖和碱基都不同
C. 核糖不同而碱基相同
D. 核糖相同而碱基不相同
E. 核糖不同而部分碱基不同

正确答案：E。核糖不同而部分碱基不同